瘿在古代文献中，有五瘿之分，下列各项，不属于五瘿的是
A. 瘿痈
B. 血瘿
C. 肉瘿
D. 石瘿
E. 筋瘿

正确答案：A。瘿痈

解析：宋代《三因极一病证方论》，将本病分为气瘿、血瘿、肉瘿、筋瘿、石瘿（BCDE对）五种（A错，为本题正确答案）。